《素问·经脉别论》中“生病起于过用”观点，提示我们治病应该
A. 急则治其标
B. 标本兼治
C. 热因热用
D. 寒者热之
E. 以平为期

正确答案：E。以平为期

解析：“生病起于过用”的含义是然界气候变化、人体的正常生活行为，无论饮食起居，还是劳作、情志等，通常情况下对人体没有伤害，但如果没有节制，超过了机体自我协调和适应的能力，就会损伤阴阳气血，影响脏腑功能，成为疾病发生的常见病因，这种病因观是与古代“过犹不及”“过则为灾”的哲理一脉相承，提示我们治病应该以平为期（E对）。